传染过程是指
A. 病原体从传染源排出后，侵入新的易感宿主前，在外环境中所经历的全过程
B. 传染病在人群中连续传播的过程必须具备传染源、传播途径及易感人群三个基本环节
C. 病原体侵入机体后，与机体相互作用、相互斗争的过程
D. 病原体不断更替宿主的过程
E. 病原体传播的媒介

正确答案：C。病原体侵入机体后，与机体相互作用、相互斗争的过程